中国药典中，硫酸亚铁片的含量测定方法为
A. 用碘滴定液滴定，淀粉作指示剂
B. 用碘滴定液滴定，邻二氮菲作指示剂
C. 用硫酸铈滴定液滴定，淀粉作指示剂
D. 用硫酸铈滴定液滴定，邻二氮菲作指示剂
E. 用EDTA滴定液滴定，邻二氮菲作指示剂

正确答案：D。用硫酸铈滴定液滴定，邻二氮菲作指示剂

解析：本题考查铈量法。中国药典中，硫酸亚铁片的含量测定方法为用硫酸铈滴定液滴定，邻二氮菲作指示剂（D对）。铈量法是以四价铈离子溶液为标准溶液的氧化还原滴定方法，常用硫酸铈的硫酸溶液作滴定剂，以邻二氮菲为指示剂。由于不受制剂中淀粉、糖类的干扰，因此特别适合片剂、糖浆剂等制剂的测定。《中国药典》2005年版采用铈量法测定的药物有：硫酸亚铁片及硫酸亚铁缓释片、葡萄糖酸亚铁及其制剂、富马酸亚铁及其制剂等（ABCE错）。